硫脲类抗甲状腺药引起的严重不良反应是
A. 低蛋白血症
B. 心动过速
C. 黏液性水肿
D. 再生障碍性贫血
E. 粒细胞缺乏症

正确答案：E。粒细胞缺乏症

解析：本题考查硫脲类抗甲状腺药引起的不良反应。硫脲类抗甲状腺药引起的严重不良反应是粒细胞缺乏症（E对），其他不良反应包括胃肠道反应、过敏反应、甲状腺肿及甲状腺功能减退等。